小网膜
A. 位于肝与胃小弯之间
B. 右侧为肝胃韧带
C. 深面有横结肠及其系膜
D. 内有胃左、右血管通过
E. 对胃和肝起保护作用

正确答案：D。内有胃左、右血管通过

解析：小网膜位于肝、胃小弯和十二指肠之间(A错)，左侧为肝胃韧带(B错)，大网膜内有横结肠及其系膜(C错)，小网膜内有胃左、右血管通过(D对)，小网膜对胃和肝不起保护作用(E错)。